下列各项，不属于噎膈初期的治法是
A. 理气
B. 化痰
C. 消瘀
D. 散寒
E. 降火

正确答案：D。散寒

解析：噎膈初期，痰气阻于食道和胃，所以吞咽会感觉不顺，继则瘀血内结，痰、气、瘀三者错杂为患，胃失和

降，上下不通，从而导致饮食难下，食而复出，所以治疗应该理气（A对）、化痰（B对）、消瘀（C对）、降火（E对）。疾病后期气郁化火，或痰瘀生热，都会耗伤阴液，若阴液日益枯槁，则虚火上炎，胃失润降；若阴损及阳，则脾肾阳虚，所以治疗应该滋阴润燥，或补气温阳。故（D错，为本题正确答案）。